乳剂中分散相乳滴合并，且与连续相分离成不相混溶的两层液体的现象，称为
A. 胶体溶液型液体药剂
B. 破裂
C. 起昙
D. 溶胶剂
E. 絮凝

正确答案：B。破裂